对诊断心肌梗死最有意义的是
A. 血清碱性磷酸酶
B. 肌酸磷酸激酶
C. 淀粉酶
D. 血清转氨酶
E. γ-谷氨酰基转肽酶

正确答案：B。肌酸磷酸激酶

解析：血清肌酸激酶检测是急性心肌梗死早期诊断的敏感指标之一，在急性心肌梗死病程中，如CK再次升高，往往说明心肌再梗死（B对）。血清碱性磷酸酶主要存在于肝脏、骨骼、肾脏、小肠及胎盘中（A错）。淀粉酶多用于急性胰腺炎的诊断（C错）。当肝细胞发生炎症、坏死、中毒等，造成肝细胞受损时，转氨酶便会释放到血液里，使血清转氨酶升高。ALT水平可以比较敏感地监测到肝脏是否受到损害（D错）。γ-谷氨酰基转肽酶在肾脏中表达最高，其次是胰脏和肝脏（E错）。